下列哪一项不属于食品卫生监督职责
A. 对食品生产经营企业的新建、扩建、改建工程的选址和设计进行卫生审查，并参加工程验收
B. 对食物中毒和食品传染事故进行调查，并采取控制措施
C. 对违反食品卫生法的行为追查责任，依法进行行政处罚
D. 进行食品卫生监测，检验和技术指导
E. 对发生食物中毒的患者进行抢救治疗

正确答案：E。对发生食物中毒的患者进行抢救治疗